关于HBV感染特征错误的是
A. 可通过血液感染
B. 可通过伤口感染
C. 可通过龈沟液感染
D. 可通过污染器械感染
E. 由口腔科医生传播给病人的机会多

正确答案：E。由口腔科医生传播给病人的机会多

解析：乙肝病毒在口腔临床中的传播方式主要是接触传播，通过直接接触患者的血液、唾液、龈沟液以及接触被污染的环境都可能感染疾病。掌握“口腔医疗保健中的感染”知识点。